可用于中重型糖尿病人探索剂量的药物是
A. 甲苯磺丁脲
B. 苯乙双胍
C. 普通胰岛素
D. 精蛋白锌胰岛素
E. 珠蛋白锌胰岛素

正确答案：C。普通胰岛素

解析：本题考查普通胰岛素。可用于中重型糖尿病人探索剂量的药物是普通胰岛素（C对）。甲苯磺丁脲（A错）对胰岛功能尚存的病人有效，但对1型糖尿病病人以及切除胰腺的动物无效。苯乙双胍（B错）为双胍类口服降糖药，作用机制为促进外周组织摄取葡萄糖，降低葡萄糖在肠的吸收以及糖原异生，抑制胰高血糖素的释放，从而降低血糖。普通胰岛素、精蛋白锌胰岛素（D错）、珠蛋白锌胰岛素（E错）为作用时间不同的胰岛素制剂，其作用机制均为增加葡萄糖的利用，从而使血糖降低。